居室进深与地板至窗上缘高度之比为
A. 室窗系数
B. 采光系数
C. 通风系数
D. 室深系数
E. 窗地系数

正确答案：D。室深系数

解析：本题考查室深系数。居室进深与地板至窗上缘高度之比为室深系数（D对ACE错）。采光系数（B错）是指室内工作水平面上（或距窗1米处）散射光的照度与室外相同时间空旷无遮光物的地方接受整个天空散射光（全阴天，见不到太阳，但不是雾天）的水平面上照度的百分比（%）。